根据《处方药与非处方药流通管理暂行规定》销售处方药和甲类非处方药的零售药店必须
A. 具有药品经营许可证
B. 配备驻店执业药师或药师以上药学技术人员
C. 将处方留存1年备查
D. 将内服药和外用药分柜摆放
E. 配备质量授权人

正确答案：A、B。具有药品经营许可证；配备驻店执业药师或药师以上药学技术人员

解析：本题考察药品经营管理。销售处方药和甲类非处方药的零售药店必须具有药品经营许可证（A对）、配备驻店执业药师或药师以上药学技术人员（B对）。